口腔修复中X线曲面断层片意义在于
A. 确定牙槽骨内是否有残根存留和第三磨牙埋伏阻生
B. 评价牙槽骨支持组织的状况
C. 判断牙根的形态
D. 确定有无龋坏
E. 以上内容均是意义所在

正确答案：A。确定牙槽骨内是否有残根存留和第三磨牙埋伏阻生

解析：本题考查口腔修复中X线曲面断层片的意义。口腔修复中X线曲面断层片意义在于确定牙槽骨内是否有残根存留和第三磨牙埋伏阻生（A对）。 全口牙位曲面体层X线片可全面了解颌骨及牙列、牙周情况，对确定牙槽骨内是否有残根存留，有无第三磨牙埋伏阻生，颌骨内有无肿物等异常很有帮助。由于全口牙位曲面体层X线片将图像放大较多，变形较严重，因此在判断和评价牙槽骨支持组织的状况（B错）、牙根的形态（C错）、有无龋坏（D错）或龋坏的范围等方面不够准确。